板蓝根除了清热解毒外，还可
A. 散风
B. 凉血
C. 祛痰
D. 疏肝
E. 敛肺

正确答案：B。凉血

解析：本题考查的是板蓝根的功效。板蓝根除了清热解毒外，还可凉血（B对）。板蓝根：【功效】清热解毒，凉血，利咽。荆芥：【功效】散风（A错）解表，透疹止痒，止血。射干：【功效】清热解毒，祛痰（C错）利咽，散结消肿。木蝴蝶：【功效】清热利咽，疏肝（D错）和胃。白果：【功效】敛肺（E错）平喘，止带缩尿。